在房颤治疗中，关于控制心室率常用药物用法用量的说法，错误的是
A. 比索洛尔片，每次5mg，每日2次，口服
B. 酒石酸美托洛尔片，每次25mg，每日2次，口服
C. 琥珀酸美托洛尔缓释片，每次47.5mg，每日1次，口服
D. 卡维地洛片，每次25mg，每日2次，口服
E. 胺碘酮胶囊，每次100mg，每日1次，口服

正确答案：A。比索洛尔片，每次5mg，每日2次，口服

解析：本题考查房颤患者心室率控制常用药物及其剂量。房颤患者控制心室率中，比索洛尔片的剂量为：每次2.5～10mg，每日1次，口服（A错，为本题正确答案）。酒石酸美托洛尔片，每次25mg，每日2次，口服（B对）。琥珀酸美托洛尔缓释片，每次47.5mg，每日1次，口服（C对）。卡维地洛片，每次25mg，每日2次，口服（D对）。胺碘酮胶囊，每次100mg，每日1次，口服（E对）。